男，40岁。间断喘憋1年余。活动量多时较明显，2天来喘憋明显加重，在夜间憋醒。1周前咽痛，发热，服用“感冒药”后好转，既往：心脏有杂音，具体情况不详，查体：T38.2℃，BP130/40mmHg，高枕卧位，双肺可闻及细湿啰音，心界向左下扩大，心率80次/分，律齐，主动脉瓣第—听诊区可闻及收缩期杂音，主动脉瓣第二听诊区可间及舒张期吹风样递减型杂音。尿常规检查可见镜下血尿。患者应采取的治疗措拖为
A. 脾切除
B. 抗凝治疗
C. 心包穿刺术
D. 大剂量糖皮质激素治疗
E. 早期充分使用抗生素

正确答案：E。早期充分使用抗生素

解析：患者中年男性，间断喘憋1年余，活动量多时较明显（劳力性呼吸困难）。1周前有上感病史，2天来喘憋明显加重，在夜间憋醒（夜间阵发性呼吸困难），提示患者心衰加重。查体，T38.2℃（正常<37.5℃），考虑感染性发热，BP130/40mmHg（正常90-120/60-90mmHg）。既往心脏有杂音，现主动脉听诊提示主动脉瓣狭窄伴关闭不全，瓣膜病为亚急性心内膜炎的重要病因。尿常规检查可见镜下血尿，提示体内感染可能迁移至肾。综合患者病史和临床表现，考虑患者患感染性心内膜炎（IE）。抗微生物药物治疗为IE最应采取的治疗措施（E对）。